某药的半衰期为5小时，单次给药后，约97%的药物从体内消除需要的时间是
A. 10小时
B. 25小时
C. 48小时
D. 120小时
E. 240小时

正确答案：B。25小时

解析：本题考查单室模型静脉滴注给药。某药的半衰期为5小时，单次给药后，约97%的药物从体内消除需要的时间为25小时（B对）。药物半衰期即药物在体内的量或血药浓度降低一半所需的时间，体内药量w用半衰期个数n表示为w/（2ⁿ），题中药物消除97%，剩余药量为3%，代入公式得n=5，半衰期个数为5，即25小时。